经产妇，35岁，妊娠40周，规律宫缩8小时，近2小时产程无进展，静滴缩宫素后，产妇烦躁不安，腹痛加重，腹部拒按，出现病理缩复环，胎心90次/分，宫口扩张2cm，S-1.最可能的诊断是
A. 胎膜早破伴感染
B. 子宫破裂
C. 羊水栓塞
D. 重度胎盘早剥
E. 先兆子宫破裂

正确答案：E。先兆子宫破裂

解析：经产妇，妊娠40周，规律宫缩8小时，近2小时产程无进展，静滴缩宫素后，产妇烦躁不安，腹痛加重，腹部拒按，出现病理缩复环（先兆子宫破裂的特征性体征），胎心90次/分（正常值为110～160次/分，胎心下降），宫口扩张2cm，S-1。根据该患者的临床症状及体征，考虑最可能的诊断是先兆子宫破裂（E对），胎膜早破（A错）主要临床表现是孕妇突感较多液体自阴道流出，增加腹压时阴道流液量增多。子宫破裂（B错）常发生于瞬间，产妇突感下腹一阵撕裂样剧痛，子宫收缩骤然停止。全腹压痛明显、有反跳痛，腹壁下可清楚扪及胎体，子宫位于侧方，胎心胎动消失。羊水栓塞（C错）骤然出现的低氧血症、低血压（血压与失血量不符合）和凝血功能障碍为特征，也称羊水栓塞三联征。重度胎盘早剥（D错）子宫呈板状，压痛明显，胎心率改变或消失，甚至出现恶心、呕吐、出汗、 面色苍白、脉搏细弱、血压下降等休克征象。